关于噬菌体生物性状叙述错误的是
A. 能通过细菌滤器
B. 不具有抗原性
C. 主要成分是核酸和蛋白质
D. 必须在活菌内寄生
E. 具有严格的宿主特异性

正确答案：B。不具有抗原性